下列关于青春期龈炎描述正确的是
A. 附着水平降低
B. 牙槽骨吸收缓慢
C. 颜色苍白，质地脆
D. 女性患者稍多于男性
E. 好发于前牙舌侧牙龈

正确答案：D。女性患者稍多于男性

解析：青春期龈炎男女均可患病，但女性患者稍多于男性，好发于前牙唇侧的牙龈乳头和龈缘，舌侧牙龈较少发生。唇侧牙龈肿胀较明显，龈乳头常呈球状突起，颜色暗红或鲜红，光亮，质地软，探诊出血明显。龈沟可加深形成龈袋，但附着水平无变化，亦无牙槽骨吸收。患者的主诉症状常为刷牙或咬硬物时出血，口臭等。掌握“青春期龈炎”知识点。